毒力强，所引起的菌痢症状重的是
A. 痢疾志贺菌
B. 福氏志贺菌
C. 变形杆菌
D. 鲍氏志贺菌
E. 宋内志贺菌

正确答案：A。痢疾志贺菌

解析：痢疾志贺菌（A对）能产生最强外毒素，具有肠毒性、神经毒性、细胞毒性，毒力最强，为产生外毒素的唯一菌群，临床症状较严重。福氏志贺菌（B错）为目前我国农村细菌性痢疾流行的优势菌群，感染后易转为慢性，为目前国内常见的痢疾杆菌菌群，具有强烈的内毒素，不产生外毒素。变形杆菌（C错）不属于细菌性痢疾的致病菌群。鲍氏志贺菌（D错）具有强烈的内毒素，不产生外毒素，毒力较弱。宋内志贺菌（E错）为目前我国城市地区流行的优势菌群，感染多为不典型发作，具有强烈的内毒素，不产生外毒素，毒力较弱。